“鱼与熊掌不可兼得”，这种动机冲突是
A. 双趋冲突
B. 双避冲突
C. 趋避冲突
D. 双重趋避冲突
E. 双趋双避冲突

正确答案：A。双趋冲突